下列不属于慢性肾小球肾炎表现的是
A. 低血压
B. 蛋白尿
C. 高血压
D. 水肿
E. 血尿

正确答案：A。低血压

解析：慢性肾小球肾炎的典型临床表现特点有：①蛋白尿 慢性肾小球肾炎必有的表现，尿蛋白常在1～3g/d（B对）。②血尿 多为镜下血尿，也出现肉眼血尿及管型尿（E对）。③水肿 多为眼睑水肿和（或）下肢轻、中度可凹陷水肿，一般无体腔积液（D对）。④高血压 可为轻度，或持续的中度以上高血压（C对）。⑤肾功能损害 呈慢性进行性损害，可因感染、劳累、血压升高或肾毒性药物而急剧恶化，去除诱因后肾功能可在一定程度上缓解。⑥其他 肾衰竭时病人可出现贫血（A错，为本题正确答案）。